治疗慢性肝炎肝肾阴虚证，应首选
A. 茵陈蒿汤
B. 逍遥散
C. 一贯煎
D. 膈下逐瘀汤
E. 龙胆泻肝汤

正确答案：C。一贯煎

解析：一贯煎（C对）具有养血柔肝、滋阴补肾的功效，常用于慢性肝炎肝肾阴虚证，症见头晕耳鸣，两目干涩，咽干，失眠多梦，五心烦热，腰膝酸软，女子经少或经闭，舌红体痩、少津或有裂纹，脉细数，茵陈蒿汤（A错）具有清热利湿解毒的功效，常用于慢性肝炎湿热中阻证；逍遥散（B错）具有疏肝解郁，健脾和中的功效，常用于慢性肝炎肝郁脾虚证；膈下逐瘀汤（D错）具有活血化瘀、通络散结的功效，常用于慢性肝炎瘀血阻络证；龙胆泻肝汤（E错）具有清泻肝胆实火、清利肝经湿热的功效，主治肝胆实火上炎证及肝经湿热下注证。